下列哪项不是前瞻性研究的特点
A. 可直接计算发病率
B. 多数情况下要计算人年发病（死亡）率
C. 多用于罕见疾病
D. 每次调查能同时研究几种疾病
E. 因素可分为几个等级，便于分析剂量-反应关系

正确答案：C。多用于罕见疾病